颞下颌关节骨关节病表现为
A. 开口初、闭口末清脆单声弹响
B. 开口末、闭口初清脆单声弹响
C. 最大开口位关节弹响
D. 连续摩擦音或多声破碎音
E. 一般无弹响

正确答案：D。连续摩擦音或多声破碎音

解析：骨关节病：关节盘破裂、穿孔的主要症状是下颌运动的任何阶段有多声破碎音和开口型歪曲；髁突骨质退行性变主要症状是开闭口运动中连续摩擦音。若伴有滑膜炎或关节囊炎，则有开口和咀嚼痛、开口受限等症状。掌握“颞下颌关节紊乱”知识点。